治疗中焦虚寒肝气上逆之巅顶头痛，宜选用
A. 丁香
B. 肉桂
C. 吴茱萸
D. 干姜
E. 花椒

正确答案：C。吴茱萸

解析：吴茱萸辛热香散，苦降而燥，入肝、脾、胃经，有小毒而力较强。既善温中散寒止痛，又能疏肝下气，还能燥湿助阳而止泻，是治中寒肝逆或寒郁肝脉诸痛之佳品，可用于中焦虚寒肝气上逆之巅顶头痛，同时也是治经寒痛经、寒湿脚气及虚寒泄泻之要药。丁香（A错）辛香温散沉降，药力较强。入脾、胃经，善温中降逆，治中寒呃逆。入肾经，能温肾助阳，治肾阳虚诸证。肉桂（B错）辛甘而热，纯阳温散。入肾经，善温补命门之火而益阳消阴、引火归元，为治下元虚冷、虚阳上浮之要药。入脾经，善温脾阳、散寒邪，为治阳虚中寒之佳品。入心、肝经，善散血分阴寒而温经通脉，为治寒凝血瘀所常用。干姜（D错）辛热温散。入脾、胃经，既祛脾胃寒邪，又助脾胃阳气，为温中散寒之要药，无论实寒、虚寒证皆宜。入心经，能回阳通脉，常配附子治亡阳欲脱。入肺经，能温肺化饮，治寒饮咳喘常投。花椒（E错）辛热燥散，入脾、胃、肾经，有小毒而力较强。善温中散寒而止痛，并兼燥湿，治中寒腹痛吐泻；能杀虫，治虫积腹痛及湿疹阴痒。